下列不属于突发公共事件
A. 自然灾害
B. 恐怖袭击事件
C. 食物中毒
D. 森林火灾
E. 重大交通事故

正确答案：C。食物中毒

解析：突发公共事件是指突然发生，造成或者可能造成严重社会危害，需要采取应急处置措施予以应对的公共卫生事件、社会安全事件、自然灾害（A对）和事故灾难。公共卫生事件，主要包括传染病疫情，群体性不明原因疾病，食品安全和职业危害，动物疫情，以及其他严重影响公众健康和生命安全的事件。本题中“食物中毒”并未说明是群体性事件并严重影响公共健康和生命安全（C错，为本题正确答案）。社会安全事件，主要包括恐怖袭击事件（B对），经济安全事件和涉外突发事件等。自然灾害，主要包括水旱灾害，气象灾害，地震灾害，地质灾害，海洋灾害，生物灾害和草原森林火灾（D对）等。事故灾难，主要包括工矿商贸等企业的各类安全事故，重大交通事故（E对），公共设施和设备事故，环境污染和生态破坏事件等。